子宫内膜异位症最主要的临床表现是
A. 经期第1～2日出现腹痛
B. 两侧下腹剧烈腹痛
C. 经期腹痛伴发热
D. 经期腹痛伴肛门坠胀感
E. 继发性痛经，进行性加重

正确答案：E。继发性痛经，进行性加重

解析：子宫内膜异位症最主要的临床表现是继发性痛经、进行性加重（E对）。疼痛多位于下腹、腰骶及盆腔中部，有时可放射至会阴部、肛门及大腿，常于月经来潮时出现，并持续至整个经期（A错）。两侧下腹剧烈腹痛（B错）为急性输卵管炎的主要临床表现。经期腹痛伴发热（C错）可能为经期感染。经期腹痛伴肛门坠胀感（D错）无特异性。